不能与芒硝同用的药有
A. 姜黄
B. 大黄
C. 硫黄
D. 三棱
E. 三七

正确答案：C、D。硫黄；三棱

解析：本题考查的是饮片的用药禁忌。不能与芒硝同用的药有硫黄（C对）与三棱（D对）。十九畏列述了九组十九味相反药，具体是：硫黄畏朴硝（包括芒硝、玄明粉），水银畏砒霜，狼毒畏密陀僧，巴豆（包括巴豆霜）畏牵牛子（包括黑丑、白丑），丁香（包括母丁香）畏郁金，川乌（包括附子）、草乌畏犀角，芒硝（包括玄明粉）畏三棱，官桂畏石脂，人参畏五灵脂。姜黄（A错）、大黄（B错）与三七（E错）的配伍禁忌，2022年考试指南未明确说明。